男，55岁。诊断乙肝肝硬化4年，黑便2天，不认家人、吵闹2小时。下列治疗中不恰当的是
A. 静脉应用奥美拉唑
B. 口服地西泮
C. 静脉应用生长抑素
D. 口服乳果糖
E. 口服利福昔明

正确答案：B。口服地西泮

解析：中年男性，有原发肝病（有肝病基础），消化道出血（肝性脑病常见诱因），中枢神经系统功能异常（肝性脑病常见症状），结合上述病史和临床表现，最可能的诊断为肝性脑病，由于地西泮（B错，为本题正确答案）可诱发其病情加重，不适宜使用。静脉应用奥美拉唑（A对）、生长抑素（C对）有助于治疗其消化道出血；口服乳果糖（D对）可减少肠内氮源性毒物的生成和吸收；利福昔明（E对）为肠道广谱抗生素，对多数革兰阳性菌和革兰阴性菌，包括需氧菌和厌氧菌的感染具有杀菌作用，可减少循环中的肠源性内毒素，有助于促进富含TNF-α和白细胞素-17E的肠道微环境的形成，增强对入侵病原菌的抗菌反应，并促进肠道屏障修复。